减鼻充血药所致的典型不良反应是
A. 心率减慢
B. 血管舒张
C. 血压升高
D. 共济失调
E. 面部潮红

正确答案：C。血压升高

解析：本题考查减鼻充血药的不良反应。减鼻充血药所致的典型不良反应是血压升高（C对）。减鼻充血药的典型不良反应：偶见一过性轻微烧灼感，鼻黏膜干燥感，头痛，头晕，心率加快（A错），长期使用可致心悸，焦虑不安，失眠等。滴药过频易致反跳性鼻充血，久用可致药物性鼻炎。偶有患者使用后出现血压升高（B错）。